颞下颌关节急性脱位后限制下颌运动的固定方法可采用
A. 十字绷带包扎
B. 颅颌绷带包扎
C. 三角绷带包扎
D. 单眼绷带包扎
E. 四头绷带包扎

正确答案：B。颅颌绷带包扎

解析：颞下颌关节急性脱位后限制下颌运动的固定方法可采用颅颌绷带，且开口度不能超过1cm。掌握“颞下颌关节紊乱”知识点。